下列关于医疗机构的药事管理与药物治疗学委员会机构设置与组织架构的说法，错误的是
A. 该委员会属于医疗机构常设的行政管理部门
B. 该委员会日常工作由药学部门负责
C. 该委员会主任委员应当是医疗机构负责人
D. 二级以上医院应当设立该委员会

正确答案：A。该委员会属于医疗机构常设的行政管理部门

解析：本题考查医疗机构药事管理机构设置与组织架构。药事管理组织是促进临床合理用药、科学管理医疗机构药事工作、具有学术研究性质的内部咨询机构，既不是行政管理部门（A错，为本题正确答案），也不属于常设机构。药事管理与药物治疗学委员会（组）应当建立健全相应工作制度，日常工作由药学部门负责（B对）。药事管理与药物治疗学委员会（组）设主任委员1名，由医疗机构负责人（C对）担任，要求医疗机构负责人承担该医疗机构用药管理的责任。《医疗机构药事管理规定》将原先的药事管理委员会更名调整为药事管理与药物治疗学委员会，明确二级以上医院应当设立药事管理与药物治疗学委员会（D对），其他医疗机构应当成立药事管理与药物治疗学组。